川乌中的生物有很强的毒性，其中毒性最大的是
A. 单酯型生物碱
B. 季铵型生物碱
C. 双酯型生物碱
D. 酰胺型生物碱
E. 醇胺型生物碱

正确答案：C。双酯型生物碱

解析：本题考查的是川乌中主要毒性生物碱及其化学结构。川乌中的生物有很强的毒性，其中毒性最大的是双酯型生物碱（C对）。川乌中主要毒性生物碱及其化学结构：乌头和附子主要含二萜类生物碱，属于四环或五环二萜类衍生物。乌头生物碱的结构复杂、结构类型多。其重要和含量较高的有乌头碱、次乌头碱和新乌头碱。《中国药典》以三者为指标成分进行含量测定，要求三者总量应为0.050～0.17%。由于C₁₄和C₈的羟基常和乙酸、苯甲酸结合成酯，故称它们为二萜双酯型生物碱。川乌中主要毒性生物碱在炮制过程中的变化：乌头碱、次乌头碱、新乌头碱等为双酯型生物碱，具麻辣味，毒性极强，是乌头的主要毒性成分。若将双酯型生物碱在碱水中加热，或将乌头直接浸泡于水中加热，或不加热仅在水中长时间浸泡，都可水解酯基，生成单酯型生物碱（A错）或无酯键的醇胺型生物碱（E错）。如乌头碱水解后生成的单酯型生物碱为乌头次碱，无酯键的醇胺型生物碱为乌头原碱。单酯型生物碱的毒性小于双酯型生物碱，而醇胺型生物碱几乎无毒性，但它们均不减低原双酯型生物碱的疗效。这就是乌头及附子经水浸、加热等炮制后毒性变小的化学原理。季铵型生物碱（B错）常见的有小檗碱，主要存在于黄连、黄柏、三棵针等中药中。酰胺型生物碱（D错）常见的有胡椒碱、秋水仙碱、咖啡碱等。